肛梳又可称为
A. 肛直肠线
B. 白线
C. 痔环
D. 肛皮线
E. 肛直肠环

正确答案：C。痔环

解析：肛梳又可称为痔环(C对)。白线(B错)又称Hilton线，齿状线又称肛皮线(D错)。